患者，女，62岁。近2年劳动行走或咳嗽时阴道内有物脱出，小腹坠痛，四肢无力，少气懒言，面色无华，小便频数，舌淡，苔薄，脉虚细。诊断为轻度子宫脱垂，治疗应首选的方剂是
A. 归脾汤
B. 补中益气汤
C. 大补元煎
D. 八珍汤
E. 举元煎

正确答案：B。补中益气汤

解析：本题患者子宫脱垂，由于中气下陷，升举无力，则小腹坠痛；带脉失约，冲任虚损，损伤胞络而使胞宫失于维系，则脏器下垂。脾虚气血生化乏源，肢体失养，则四肢无力，少气懒言；面部失荣，则面色无华。脾主升清，脾气下陷，小肠清浊不分，则小便频数。舌淡，苔薄，脉虚细是中气下陷之征，所以宜用补中益气汤（B对）；归脾汤具有益气补血，健脾养心的功效，主治心脾气血两虚证，症见心悸怔忡，健忘失眠，盗汗，体倦食少，面色萎黄，舌淡，苔薄白，脉细弱（A错）；大补元煎具有补肾固脱，益气升提的功效，可以用于治疗子宫脱垂的肾气虚亏证，症见阴中有物脱出，久脱不复，腰酸腿软，头晕耳鸣，小便频数或不利，小腹下坠。舌质淡苔薄，脉沉弱（C错）；八珍汤具有益气补血之功效，主治气血两虚证，症见面色苍白或萎黄，头晕耳眩，四肢倦怠，气短懒言，心悸怔忡，饮食减少，舌淡苔薄白，脉细弱或虚大无力（D错）；举元煎具有益气升提的功效，主治气虚下陷、血崩血脱、亡阳垂危等证（E错）。